物种差异影响化合物的毒性的例子是
A. 大鼠、小鼠、狗体内发生N-羟化，N-2-乙酰氨基芴与硫酸结合变成致癌物
B. 猴体内可发生N-羟化，N-2-乙酰氨基芴与硫酸结合变成致癌物
C. 家兔体内可发生N-羟化，N-2-乙酰氨基芴与硫酸结合变成致癌物
D. 豚鼠体内可发生N-羟化，N-2-乙酰氨基芴与硫酸结合变成致癌物
E. 猫体内可发生N-羟化，N-2-乙酰氨基芴与硫酸结合变成致癌物

正确答案：A。大鼠、小鼠、狗体内发生N-羟化，N-2-乙酰氨基芴与硫酸结合变成致癌物